在我国局部地区被违规做饲料添加剂，俗称瘦肉精的药物
A. 沙丁胺醇
B. 盐酸克仑特罗
C. 盐酸多巴胺
D. 沙美特罗
E. 盐酸多巴酚丁胺

正确答案：B。盐酸克仑特罗

解析：本题考查克仑特罗。克仑特罗（B对）被用作动物饲料的添加剂，以促进增加体重和肌肉质量，俗名“瘦肉精”。因残留克仑特罗，导致食肉者出现拟交感药的毒副作用，我国现已严格禁止作饲料添加剂。